患者月经先后无定期，经来量少，色淡暗，质稀，头晕耳鸣，腰骶酸痛。治疗应首选
A. 固阴煎
B. 六味地黄丸
C. 大补元煎
D. 左归丸
E. 归肾丸

正确答案：A。固阴煎

解析：肾气虚弱，封藏失司，冲任失调，血海蓄溢无常，以致月经先后不定期；肾气亏损，阴阳两虚，阴不足则经血少，阳不足则经色淡、质清稀；腰骶酸痛，头晕耳鸣均为肾气不足之征为肾气不足征；其病机是肾气虚弱，封藏失司，阴阳两虚，冲任失调；治宜补肾益气，固冲调经；方用疏肝解郁，补肾固冲调经之固阴煎（A对）。左归丸用于治疗无排卵性功血的肾虚证（D错）。